颊舌侧卡臂尖均可进入倒凹区，适合于近远中均有缺隙的孤立磨牙或前磨牙
A. 圈形卡环
B. 回力卡环
C. 对半卡环
D. RPI卡坏
E. 三臂卡环

正确答案：C。对半卡环

解析：对半卡环：由颊、舌侧两个相对的卡环臂和近、远中支托组成，用于前后有缺隙、孤立的前磨牙或磨牙上。临床上常用舌侧基托代替舌侧卡环臂，起到对抗臂的作用。掌握“局部义齿固位体”知识点。